成釉细胞瘤的临床特征错误的是
A. 以下颌骨体及下颌角部为常见
B. 可使牙齿松动、移位或脱落
C. 多呈多房性，并有一定程度的局部浸润性
D. 不会造成下唇及颊部麻木
E. 可造成下颌骨病理性骨折

正确答案：D。不会造成下唇及颊部麻木

解析：成釉细胞瘤多发生于青壮年。以下颌体及下颌角部为常见。生长缓慢，初期无自觉症状；逐渐发展可使颌骨膨大，造成畸形，左右面部不对称。如肿瘤侵犯牙槽突时，可使牙松动、移位或脱落；肿瘤继续增大时，使颌骨外板变薄，或甚至吸收，这时肿瘤可以侵入软组织内。由于肿瘤的侵犯，可以影响下颌骨的运动度，甚至可能发生吞咽、咀嚼和呼吸障碍。肿瘤表面常见有被对颌牙造成的压痕，如果咀嚼时发生溃疡，可能造成继发性感染而化脓、溃烂、疼痛。当肿瘤压迫下牙槽神经时，患侧下唇及颊部可能感觉麻木不适。如肿瘤发展很大，骨质破坏较多，还可能发生病理性骨折。掌握“成釉细胞瘤”知识点。